下列哪项措施不利于清除菌斑
A. 颊面靠近牙颈部处的突起一般比釉质牙骨质界突出约0.5mm为宜
B. 舌面靠近牙颈部处的突起一般比釉质牙骨质界突出约0.5mm为宜
C. 前牙使用贴面时牙颈部做得稍厚，有利于固位
D. 后牙邻面接触区的颊舌径不宜过大
E. 后牙邻面的接触区应位于中央沟的颊侧

正确答案：C。前牙使用贴面时牙颈部做得稍厚，有利于固位

解析：在颊、舌面靠近牙颈部处的突起一般比釉质牙骨质界突出约0.5mm为宜。在前牙使用贴面时也不可在牙颈部做得太厚，以免造成牙龈炎症。后牙邻面的接触区应位于中央沟的颊侧，接触区的颊舌径不宜过大，使食物得以外溢而不致嵌塞，有牙龈退缩者，制作的修复体应留出足够的空隙，以利牙间隙刷等洁牙工具能进入。掌握“牙周健康与修复”知识点。